抗体抗原反应的特异性主要依赖于
A. 抗原的相对分子质量
B. 抗体的电荷
C. 抗原和抗体的浓度
D. 抗原和抗体的构象
E. 免疫球蛋白的类别

正确答案：D。抗原和抗体的构象

解析：抗原是指可特异性的与淋巴细胞表面受体结合，产生抗体或致敏淋巴细胞，并与之结合，发挥免疫效应的物质，其特异性是由抗原的抗原表位所决定（属于抗原的构象）；抗体是体液免疫应答的重要效应分子，担负着识别结合和清除外来抗原的作用。抗原与抗体的识别和结合是特异性的，这种特异性的结构基础是免疫球蛋白的V区（属于抗体的构象），其中互补决定区（CDR）在识别和结合特异性抗原起决定作用（D对）。抗原的相对分子量（A错）主要影响抗原的免疫原性，一般来说，抗原分子量越大，含有抗原表位越多，免疫原性越强。抗体属于糖蛋白，在体内均带负电荷，故抗体的电荷（B错）不是抗原抗体反应特异性的原因。抗原和抗体的浓度（C错）主要影响机体对抗原的应答，并不影响其特异性。在体内，免疫球蛋白不同的类别，承担着不同的生物学功能，它们诱导的效应可以互补，协同发挥作用，使免疫系统尽可能地动员起来（E错）。